某患儿，因鼻塞、咽痛，家长带其去医院就诊。经门诊查体和相关化验，医师诊断为普通感冒，并为该患儿开具小儿感冒颗粒，回家后，患儿家长在电视中看到小儿感冒颗粒的广告。关于小儿感冒颗粒广告的说法，符合规定的是
A. 可以聘请童星代言广告
B. 可以聘请少儿频道主持人做广告
C. 可以宣传该药疗效最佳
D. 可以在大众媒体做广告

正确答案：D。可以在大众媒体做广告

解析：本题考查非处方药广告管理。某患儿，因鼻塞、咽痛，家长带其去医院就诊。经门诊查体和相关化验，医师诊断为普通感冒，并为该患儿开具小儿感冒颗粒，回家后，患儿家长在电视中看到小儿感冒颗粒的广告。关于小儿感冒颗粒广告的说法，符合规定的是可以在大众传媒做广告（D对）。非处方药可以在大众媒介上进行广告宣传，但广告内容必须经过审查、批准，不能任意夸大（C对）或擅自篡改。其目的是正确引导个人消费者科学、合理地进行自我药疗。《中华人民共和国广告法》第三十八条规定，不得利用不满十周岁的未成年人作为广告代言人（A错）。《中华人民共和国广告法》第二十九条规定，广播电台、电视台、报刊出版单位从事广告发布业务的，应当设有专门从事广告业务的机构，配备必要的人员（B错），具有与发布广告相适应的场所、设备，并向县级以上地方市场监督管理部门办理广告发布登记。